牙本质非胶原蛋白的作用是
A. 调节矿物质沉淀
B. 作为矿化抑制因子
C. 作为矿化启动因子
D. 作为矿化稳定因子
E. 以上说法均正确

正确答案：E。以上说法均正确

解析：牙本质非胶原蛋白的作用是调节矿物质沉淀，并且可以作为矿化的抑制因子、启动因子和稳定因子。掌握“牙本质”知识点。